肾性高血压患者可选用
A. 美加明
B. 普萘洛尔
C. 可乐定
D. 卡托普利
E. 氢氯噻嗪

正确答案：D。卡托普利